患者，男性，18岁。因寒战，发热，咽痛来诊。经检查：体温39℃，双侧扁桃体肿大Ⅱ度，诊断为急性扁桃体炎，决定用青霉素。青霉素皮试（﹣）。但注射青霉素后，病人突感头晕，恶心，呕吐，全身湿冷，面色苍白，血压已测不到，此时该用何药抢救
A. 去甲肾上腺素
B. 多巴胺
C. 肾上腺素
D. 间羟胺
E. 山莨菪碱

正确答案：C。肾上腺素